65岁女性，全口多数牙缺失，仅余留左上78，且松动Ⅲ°，牙龈红肿，牙槽嵴高度适中，颌间距离正常。修复前应做的工作是拔除左上78。拟采用的修复方法是全口义齿修复。若按正确的方法修复，制取印模的方式为上下颌均取功能性印模。协助患者下颌回到正中关系位的方法错误的是
A. 面部外形观察法
B. 吞咽法
C. 辅助法
D. 肌肉疲劳法
E. 卷舌法

正确答案：A。面部外形观察法

解析：本题考查确定正中关系位的方法。无牙颌患者确定垂直距离的方法有：息止颌位法；面部比例等分法；面部外形观察法（A错，为本题的正确答案）；发音法。无牙颌患者确定正中关系位的方法很多，一般归纳为以下两类：（1）哥特式弓描记法；（2）直接咬合法：卷舌后舔法（E对）、吞咽咬合法（B对）、后牙咬合法、诱导法、肌肉疲劳法（D对）。